关于牙震荡的描述，正确的是
A. 对牙震荡的患牙作牙髓活力测试，其反应不一
B. 年轻恒牙在受震荡后，牙髓不会丧失活力
C. 年轻恒牙在受到震荡后，活力很快丧失
D. 牙齿受到震荡后，一般有移位
E. 牙震荡一般都伴有牙体组织的缺损

正确答案：A。对牙震荡的患牙作牙髓活力测试，其反应不一

解析：本题考查牙震荡。牙震荡时若做牙髓活力测试，其反应不一（A对），通常受伤后无反应，而在数周或数月后反应开始恢复，但也有伤后一开始牙髓活力测试有反应，后来转变成无反应，对于外伤牙牙髓活力测试常获得不确切结果。年轻恒牙在受到震荡后，其活力可以在1年以后才丧失（BC错）。牙震荡伤后患牙有伸长不适感，轻微松动和叩痛，并不会有移位（D错）。牙震荡是牙周膜的轻度损伤，通常不伴牙体组织缺损（E错）。